通常被用来检验病因假说的方法是
A. 体外及动物水平研究
B. 描述性研究
C. 分析性研究
D. 实验性研究
E. 理论流行病学研究

正确答案：C。分析性研究